对乙酰氨基酚的药理作用特点是
A. 抗炎作用强，解热镇痛作用很弱
B. 解热镇痛作用缓和持久，抗炎、抗风湿作用很弱
C. 抑制血栓形成
D. 对COX-2的抑制作用比COX-1强
E. 大剂量可减少肾小管对尿酸盐的再吸收

正确答案：B。解热镇痛作用缓和持久，抗炎、抗风湿作用很弱

解析：本题考查对乙酰氨基酚的药理作用。对乙酰氨基酚的药理作用特点是解热镇痛作用缓和持久，抗炎、抗风湿作用很弱（B对）。对乙酰氨基酚解热作用缓和持久，抗炎作用极弱（A错），无明显胃肠刺激。阿司匹林可抑制血栓形成（C错）。COX-1存在于大多数组织中，因此对乙酰氨基酚对其作用很强，而COX-2主要存在于炎症部位，由于对乙酰氨基酚的抗炎作用很弱，可知其对COX-2的作用很弱（D错）。由于对乙酰氨基酚显酸性，会使尿的PH下降，导致尿酸单体析出增多，随尿排出增多，再吸收减少（E错）。